内发丹毒的治法是
A. 疏风清热解毒
B. 清肝泻火利湿
C. 利湿清热解毒
D. 凉血清热解毒
E. 清热解毒透脓

正确答案：B。清肝泻火利湿

解析：内发丹毒发于躯干，多为肝脾湿火证，症候：发于胸腹腰胯部，皮肤红肿蔓延，摸之灼手，肿胀疼痛；伴口干口苦；舌红，苔黄腻，脉弦滑数，治疗当清肝泻火利湿（B对）。